关于婴儿期特点下列哪项是错误的
A. 体格生长发育和神经精神发育极为迅速
B. 对蛋白质的能量需求相对较高
C. 消化吸收功能尚不健全
D. 容易发生消化不良和营养紊乱
E. 对传染病的免疫力较新生儿期增强

正确答案：E。对传染病的免疫力较新生儿期增强

解析：本题考查婴儿期的特点。婴儿期由于从母体所获的免疫力逐渐消失，而自身后天获得的免疫力尚不完善，故易患感染性疾病（E错，为本题正确答案）。婴儿期的特点：1、体格生长发育和神经精神发育极为迅速（A对）；2、对蛋白质的能量需求相对较高（B对）；3、消化吸收功能尚不健全（C对）；4、容易发生消化不良和营养紊乱（D对）。